在非处方药中氢溴酸右美沙芬的适应证是
A. 胃酸过多、烧心
B. 关节痛、神经痛
C. 手足癣、体癣、股癣、头癣
D. 蛔虫病、蛲虫病
E. 无痰干咳、频繁剧烈的咳嗽

正确答案：E。无痰干咳、频繁剧烈的咳嗽

解析：本题考查右美沙芬。在非处方药中氢溴酸右美沙芬的适应证是无痰干咳、频繁剧烈的咳嗽（E对）。氢溴酸右美沙芬通过抑制延脑咳嗽中枢而产生镇咳作用，其镇咳作用与可待因相等或稍强。一般治疗剂量不抑制呼吸，长期服用无成瘾性和耐受性。适用于无痰干咳，包括频繁、剧烈的咳嗽，用药一周症状不缓解，应去医院就医。应根据咳嗽的症状和类型选药：（一）非处方药 刺激性干咳或阵咳宜选用苯丙哌林；咳嗽频繁或程度剧咳者宜选苯丙哌林，其为非麻醉性强效镇咳药，次选右美沙芬；根据时间选择：白天咳嗽宜选用苯丙哌林，夜间咳嗽选择右美沙芬；感冒伴随的咳嗽选用右美沙芬复方制剂。（二）处方药 对频繁、剧烈无痰干咳及刺激性咳嗽，可考虑可待因；对呼吸道大量痰液并阻塞呼吸道，应及时应用司坦类如羧甲司坦等黏液调节剂；对合并气管炎、支气管炎等应服用抗感染药物（抗生素类等）。